关于药物效价强度的说法，正确的是
A. 用于药物内在活性的比较
B. 用于作用性质相同的药物等效浓度或剂量的比较
C. 用于引起药理效应的最低药物浓度或剂量的比较
D. 用于相同剂量或浓度下药物效应的比较
E. 用于药物安全范围的比较

正确答案：E。用于药物安全范围的比较

解析：本题考查效价强度。效价强度是指能引起等效反应（一般采用50%效应量）的相对剂量或浓度。效价强度用于作用性质相同的药物之间的等效剂量或浓度的比较（B对），其值越小则强度越大。